引起小儿假膜性肠炎的最常见的病原菌是
A. 难辨梭状芽胞杆菌
B. 侵袭性大肠杆菌
C. 空肠弯曲菌
D. 金黄色葡萄球菌
E. 白色念珠菌

正确答案：A。难辨梭状芽胞杆菌

解析：由难辨梭状芽胞杆菌（A对）引起的假膜性小肠结肠炎、由金黄色葡萄球菌（D错）引起的金黄色葡萄球菌肠炎及由白色念珠菌（E错）引起的真菌性肠炎均为抗生素相关性腹泻，由于长期、大量的使用抗生素，引起一系列药物较难控制的肠炎；而由侵袭性大肠杆菌（B错）、空肠弯曲菌（C错）等侵袭性细菌可引起侵袭性肠炎。